男，69岁，因乏力、心律失常，体征实验检查：餐前血糖5.8mmol/L，餐后12.4mmol/L，糖化血红蛋白7.2%，消瘦体重指数BMI20.4，应首选
A. 罗格列酮
B. 阿卡波糖
C. 二甲双胍
D. 格列本脲
E. 阿司匹林

正确答案：B。阿卡波糖

解析：本题考查降糖药的选择。餐后血糖正常值：餐后1小时：血糖6.7～9.4mmol/L。最多也不超过11.1mmol/L（200mg/dl）；餐后2小时：血糖≤7.8mmol/L；餐后3小时：第三小时后恢复正常，各次尿糖均为阴性。α-葡糖苷酶抑制剂适用于、以碳水化合物为主要食物成分和餐后血糖升高为主的糖尿病患者。题干中患者为单纯的餐后血糖高，宜选择α-葡糖苷酶抑制剂，如阿卡波糖（B对）。罗格列酮（A错）为胰岛素增敏剂，适用于治疗体胖的2型糖尿病患者。二甲双胍（C错）特别适用于过度肥胖并对胰岛素耐受的患者。格列本脲（D错）适用于胰岛素仍有功能的2性糖尿病患者。阿司匹林（E错）为解热镇痛抗炎药，不用于糖尿病的治疗。